不与脐周静脉网直接吻合的静脉是
A. 腹壁浅静脉
B. 旋髂浅静脉
C. 腹壁上静脉
D. 腹壁下静脉
E. 胸腹壁静脉

正确答案：B。旋髂浅静脉

解析：腹壁浅静脉（A对）、腹壁上静脉（C对）、腹壁下静脉（D对）、胸腹壁静脉（E对）均与脐周静脉网直接吻合。旋髂浅静脉（B错，为本题正确答案）不与脐周静脉网直接吻合。